拔除断根应在下列情况下进行，但不包括
A. 专用的诊椅
B. 清楚的视野
C. 良好的照明
D. 合适的器械
E. 良好的止血

正确答案：A。专用的诊椅

解析：本题考查牙根拔除术。拔除断根应在下列情况下进行，但不包括专用的诊椅（A错，为本题的正确答案）。拔除断根在普通牙科治疗椅上进行即可，无需专用的诊椅。拔除断根应根据检查结果制定手术方案，选择合适的手术器械（D对）。术区要求良好的照明（C对），清晰的视野（B对），良好的止血（E对），以便能更清晰的了解断根的情况，顺利拔除。